患者，女，70岁，BMI21kg/m²，45岁时绝经，10年前开始，经常出现腰背部疼痛，活动后加重，但未就诊，平日外出活动较少，近5年身高降低，驼背明显。10天前患者不慎摔倒，右上肢活动受限、疼痛，就诊后检查结果：血钙1.97mmol/L，血磷1.39mmol/L；右上肢X光检查提示：右桡骨远端骨折。骨密度检查结果：T值为-2.9。入院诊断：右桡骨远端骨折，老年性骨质疏松症。为了预防骨质疏松性骨折，给予阿仑膦酸钠70mg每周口服1次，关于阿仑膦酸钠用药指导的说法，错误的是
A. 应于早餐前至少半小时服用
B. 服药后至少30分钟内应避免卧床
C. 应在每周固定的一天服用
D. 有消化不良、吞咽困难、胃肠道功能紊乱、胃炎、十二指肠炎、溃疡病的患者慎用
E. 为提高疗效，可用牛奶送服

正确答案：E。为提高疗效，可用牛奶送服

解析：本题考查阿仑膦酸钠用药指导。阿仑膦酸钠不宜与牛奶同服（E错，为本题正确答案）。阿仑膦酸钠是第三代氨基二磷酸盐类骨代谢调节剂，其主要不良反应为食管炎、粪便潜血，凡有消化不良、吞咽困难、胃肠道功能紊乱、胃炎、十二指肠炎、溃疡病的患者慎用（D对）。为便于吸收，减少对食管的刺激，阿仑膦酸钠应于早餐前至少半小时服用（A对），并建议足量水送服，保持坐位或立位，服药后至少30分钟内应避免卧床（B对），不宜喝牛奶、咖啡等饮料或与其它药物同服。阿仑膦酸钠应在每周固定的一天服用（C对）。